胚胎期是指受孕后的
A. 8周以内
B. 9周以内
C. 10周以内
D. 11周以内
E. 12周以内

正确答案：A。8周以内

解析：孕周从末次月经第1日开始计算，通常比排卵或受精时间提前2周。胚胎期是指妊娠10周内（C错），即受孕（受精）后的8周以内（A对）的人胚，是器官分化、形成的时期。